女性，25岁。在分娩时突发呼吸困难，其后咯血而死，尸检发现肺小血管内有胎脂及角化上皮。其死因可能是
A. 血栓栓塞
B. 气体栓塞
C. 脂肪栓塞
D. 羊水栓塞
E. 瘤细胞栓塞

正确答案：D。羊水栓塞

解析：患者分娩时突发呼吸困难，其后咯血而死尸检发现肺小血管内有胎脂及角化上皮，可见患者是由污染羊水中的有形物质胎脂及角化上皮进入母体循环造成的（D对）。血栓栓塞导致器官或组织供血减少或者中断，或者血液淤积于某个器官或者组织，造成器官衰竭或功能障碍、致残、丧失工作能力、甚至死亡（A错）。气体栓塞易发生在头颈、胸壁和肺的大静脉，一旦这些血管遭受创伤，外界空气就有可能快速进入血管。若在短时间内进入血管的空气量过多，由于心脏搏动，空气与血液可在右心房和右心室中混合形成泡沫状血液，这种泡沫状血液在心脏收缩时无法排出，易阻塞于右心室和肺动脉干出口，严重时可导致血液循环中断而危及生命（B错）。脂肪栓塞常见于长骨骨折，严重脂肪组织挫伤或脂肪肝挤压伤时。脂肪栓塞主要影响肺和神经系统（C错）。肿瘤细胞的转移过程中可引起癌栓栓塞（E错）。